配制75%乙醇2000mL，应取95%乙醇约
A. 1900ml
B. 1765ml
C. 1579ml
D. 1500ml
E. 789ml

正确答案：C。1579ml

解析：本题考查溶液的配制。配制75%乙醇2000mL，应取95%乙醇约1579ml（C对）。根据溶液的配制公式C浓×V浓=C稀×V稀，代入题目数据，75%×2000mL=95%×V浓，可求出应取95%乙醇约1579ml。